小儿目前口内牙齿16颗，会用勺子吃饭，会说2～3个字构成的句子，最可能的年龄是
A. 1岁
B. 2岁
C. 3岁
D. 4岁
E. 5岁

正确答案：B。2岁

解析：2岁左右会双脚跳，会用勺子吃饭。2岁用简单的语言表达自己的需要，对人、事有喜乐之分。掌握“运动和语言发育”知识点。